女，84岁，慢阻肺30年突发意识障碍入院，有高血压、心力衰竭等并发症，医生全力抢救，但患者无治愈希望，医生与患者家属沟通后，患者家属认为没有治愈的可能不如减轻患者痛苦，给予临终关怀，临终关怀的最重要的目的是
A. 延长患者生命时间
B. 提高临终患者生命质量
C. 促进患者死亡
D. 减轻患者经济负担
E. 节约医疗卫生资源

正确答案：B。提高临终患者生命质量

解析：加强临终病人的医疗服务已成为普遍客观的社会需求，临终关怀开始逐步兴起。临终关怀是针对垂危病人进行的一种特殊医疗照护，其目的在于减轻其临终心理负担，解除其对疼痛及死亡的恐惧和不安，满足其生理、心理和社会的需求，已达到提高临终病人的生存质量（B对）的根本目的，让病人在人生的最后岁月中，能够安详、宁静、无痛苦、舒适且有尊严地离开人世，并同时使其家属的身心健康得到维护和增强。